下列关于胆囊的描述，正确的是
A. 位于肝左叶下面胆囊窝内
B. 为腹膜内位器官
C. 分泌和储存胆汁
D. 分胆囊底、体、颈、管四部
E. 与胆总管汇合后开口于十二指肠

正确答案：D。分胆囊底、体、颈、管四部

解析：胆囊位于右纵沟前部的胆囊窝内(A错)，为腹膜间位器官(B错)，肝分泌胆汁，而胆囊贮存和浓缩胆汁(C错)，胆囊分底、体、颈、管四部(D对)，其与肝总管汇合形成胆总管(E错)。